梅毒树胶样肿区别于结核肉芽肿的主要特点是
A. 易见郎罕斯巨细胞
B. 见多量中性粒细胞
C. 见干酪样坏死
D. 见多量浆细胞
E. 见多量上皮样细胞

正确答案：D。见多量浆细胞

解析：梅毒树胶样肿坏死灶周围肉芽组织中富含浆细胞，是在体液免疫的基础上形成的，而结核肉芽肿是在细胞免疫的基础上形成的，故见多量浆细胞（D对）是梅毒树胶样肿区别于结核肉芽肿的主要特点。梅毒树胶样肿上皮样细胞（E错）和朗汉斯巨细胞（A错）较少，结核肉芽肿可见多量上皮样细胞和朗汉斯巨细胞。梅毒树胶样肿和结核结节均不会见多量中性粒细胞（B错）。梅毒树胶样肿和结核结节均可见干酪样坏死（C错），故不是两者的区别。